新生儿生理性体重下降发生在出生后
A. 第1周
B. 第2周
C. 第3周
D. 第4周
E. 第5周

正确答案：A。第1周

解析：新生儿生理性体重下降发生在出生后第1周（A对）。生理性体重下降是指在出生后1～2天开始出现体重下降，且多在出生后7～10天恢复到出生时的体重。